关于骨化三醇药理特点和临床使用的说法，错误的是
A. 是肠道主动吸收钙元素的调节剂
B. 可引起高钙血症，用药过程中建议监测血钙和血肌酐
C. 骨化三醇与噻嗪类利尿剂合用，易发生高钙血症
D. 用于绝经后骨质疏松，推荐剂量是每次0.25mg，每日2次
E. 肝药酶诱导剂可能会加速骨化三醇代谢

正确答案：D。用于绝经后骨质疏松，推荐剂量是每次0.25mg，每日2次

解析：本题考查骨化三醇。骨化三醇口服用于绝经后骨质疏松症时，推荐成人剂量为一次0.25㎍，一日2次（D错，为本题正确答案）。